C3a和C5a，也称过敏毒素参与
A. 免疫黏附
B. 炎症介导
C. 调理吞噬
D. 经典途径
E. 膜攻击复合物的生物学作用

正确答案：B。炎症介导

解析：炎症介导：C3a和C5a，也称过敏毒素，可与肥大细胞或嗜碱性粒细胞表面C3aR和C5aR结合，触发其脱颗粒，释放组胺等活性介质，引发炎症反应。C5a可吸引中性粒细胞和单核-吞噬细胞向炎症部位聚集，增强炎症反应。C5a也趋化B细胞，T细胞和肥大细胞。掌握“补体功能及其与疾病的关系”知识点。